维生素K拮抗剂是
A. 香豆素类抗凝血药
B. 促凝血药
C. 纤维蛋白溶解药
D. 抗贫血药
E. 抗血小板药

正确答案：A。香豆素类抗凝血药

解析：本题考查维生素K拮抗药。维生素K拮抗剂是香豆素类抗凝血药（A对）。维生素K是凝血因子Ⅱ、Ⅶ、Ⅸ、Ⅹ活化必需的辅助因子，具有拮抗维生素K作用的药物为香豆素类抗凝药，是一类含有4-羟基香豆素基本结构的物质，口服吸收后参与体内代谢发挥抗凝作用，又称口服抗凝药。包括双香豆素、华法林（苄丙酮香豆素）和醋硝香豆素（新抗凝）等，其中以华法林最为常用。